牙根面出现牙骨质新生，见于牙周炎的
A. 始发期
B. 早期病变
C. 病损确立期
D. 进展期
E. 静止期

正确答案：E。静止期

解析：本题考查牙周炎的病理变化。牙周炎是静止期和活动期交替出现的过程。静止期炎症反应轻，牙槽骨吸收静止，有类骨质或新牙槽骨、牙骨质形成（E对）。始发期（A错）、早期（B错）、病损确立期（C错）、进展期（D错）是活动期的一系列过程，主要表现为炎症加重，附着丧失，牙周袋加深，牙槽骨吸收，牙周组织遭到进行性破坏。